易燃液体是
A. 苦味酸
B. 乙醚
C. 亚砷酸及其制剂
D. 盐酸
E. 氯化钾

正确答案：B。乙醚